心室收缩时颈静脉有搏动，可见于
A. 高血压病
B. 严重贫血
C. 三尖瓣关闭不全
D. 主动脉瓣关闭不全
E. 甲状腺功能亢进症

正确答案：C。三尖瓣关闭不全

解析：心室收缩时颈静脉有搏动，可见于三尖瓣关闭不全（C对）。高血压病（A错）、严重贫血（B错）、主动脉瓣关闭不全（D错）、甲状腺功能亢进症（E错）在安静状态下可出现明显的颈动脉搏动。